临床研究显示，人们在刷牙的初始2分钟内，牙菌斑去除量超过
A. 0.65
B. 0.75
C. 0.8
D. 0.95
E. 0.99

正确答案：C。0.8

解析：临床研究显示，人们在刷牙的初始2分钟内，牙菌斑去除量超过80%。2分钟后刷牙效率明显降低。所以，建议普通人群每次刷牙时间至少为2分钟。掌握“自我口腔保健方法”知识点。